鱼类具有一定的预防动脉粥样硬化作用是因为含有丰富的
A. 钙
B. 维生素D
C. 维生素A
D. 多不饱和脂肪酸
E. 铁

正确答案：D。多不饱和脂肪酸

解析：本题考查鱼类具有预防动脉粥样硬化作用的原因。鱼类含有丰富的多不饱和脂肪酸（D对ABCE错），因此具有一定的预防动脉粥样硬化作用。